哌唑嗪具有
A. 生理依赖性
B. 首剂现象
C. 耐药性
D. 耐受性
E. 致敏性

正确答案：B。首剂现象

解析：本题考查哌唑嗪。哌唑嗪具有首剂现象（B对）。哌唑嗪首次给药可致严重的体位性低血压、晕厥、心悸等，称“首剂现象”，多见于首次用药90分钟内，发生率高达50%。生理依赖性（A错）是阿片类药物的不良反应。耐药性（C错）是指微生物、寄生虫以及肿瘤细胞对于化疗药物作用的敏感性降低。耐受性（D错）是多次用药后反应性降低，需加大剂量才能维持原有疗效。致敏性（E错）是某药品中含有使部分过敏人群发生过敏的物质。